下列病症，属于水肿变证的是
A. 痞满
B. 消渴
C. 黄疸
D. 麻痹
E. 胸痹

正确答案：E。胸痹

解析：水肿迁延日久，病情进展，阳损及阴，阴不制阳，肝阳上亢，则见眩晕之证。若肺、脾、肾功能衰退，水湿之邪凌心犯肺，可变生心悸、胸痹（E对）、喘脱甚至昏迷、谵妄之重证。若肾阳虚衰，真阴耗竭，可见小便点滴或闭塞不通，则可转化成癃闭。病至后期，正气衰微，水湿浊毒内闭，弥漫三焦，可转变为关格。痞满一般为胃肠病症（A错）；消渴为肺胃肾阴虚表现（B错），黄疸一般由湿邪困遏脾胃，壅塞肝胆所致，鼓胀常变证为黄疸（C错）。麻痹为肢体经络病症（D错）。